香豆素类灭鼠药中毒的特效解毒剂是
A. 酚磺乙胺
B. 维生素K₁
C. 维生素K₃
D. 维生素K4
E. 氨甲环酸

正确答案：B。维生素K₁

解析：本题考查香豆素类灭鼠药中毒解救。香豆素类灭鼠药中毒的特效解毒剂是维生素K₁（B对）。香豆素类灭鼠药中毒的特效解毒剂：静脉滴注维生素K₁10～30mg, 一日1～3次；亦可先静脉注射维生素K₁50mg ，然后改为10～20mg肌内注射，一日1～4次。严重出血时每日总量可用至300mg。维生素K₃（C错）、维生素K₄（D错）无效。